外皮多已除去，表面淡黄色至黄色，有的顶端具较短根茎，茎痕半月形；横切面可见放射状裂隙，皮部黄白色，形成层环纹棕色，木部淡黄色；气微，味微甜后苦的药材是
A. 桔梗
B. 白术
C. 黄精
D. 徐长卿
E. 当归

正确答案：A。桔梗

解析：本题考查的是桔梗的性状鉴别。外皮多已除去，表面淡黄色至黄色，有的顶端具较短根茎，茎痕半月形；横切面可见放射状裂隙，皮部黄白色，形成层环纹棕色，木部淡黄色；气微，味微甜后苦的药材是桔梗（A对）。桔梗：【性状鉴别】药材呈圆柱形或略呈纺锤形，下部渐细，有的有分支，略扭曲。表面淡黄色至黄色，不去外皮的表面黄棕色至灰棕色，具纵扭皱沟，并有横长的皮孔样斑痕及支根痕，上部有横纹。有的顶端有较短的根茎或不明显，其上有数个半月形茎痕。质脆，断面不平坦，横切面可见放射状裂隙，皮部黄白色，形成层环棕色，木部淡黄色。气微，味微甜后苦。白术（B错）：【性状鉴别】药材呈不规则的肥厚团块。表面灰黄色或灰棕色，有瘤状突起及断续的纵皱和沟纹，并有须根痕，顶端有残留茎基和芽痕。质坚硬，不易折断，断面不平坦，黄白色至淡棕色，有棕黄色的点状油室散在；烘干者断面角质样，色较深，或有裂隙。气清香，味甘、微辛，嚼之略带黏性。黄精（C错）：【性状鉴别】药材大黄精呈肥厚肉质的结节块状。表面淡黄色至黄棕色，具环节，有皱纹及须根痕，结节上侧茎痕呈圆盘状，周围凹入，中部突出。质硬而韧，不易折断，断面角质，淡黄色至黄棕色。气微，味甜，嚼之有黏性。徐长卿（D错）：【性状鉴别】药材根茎呈不规则柱状，有盘节。有的顶端带有残茎，细圆柱形，断面中空；根茎节处周围着生多数细长的根。根呈细长圆柱形，弯曲。表面淡黄白色至淡棕黄色或棕色；具微细的纵皱纹，并有纤细的须根。质脆，易折断，断面粉性，切断面皮部类白色或黄白色，形成层环淡棕色，木部细小。气香（含丹皮酚），味微辛凉。当归（E错）：【性状鉴别】药材略呈圆柱形，下部有支根。表面浅棕色至棕褐色，具纵皱纹及横长皮孔样突起。根头（归头）具环纹，上端圆钝，或具数个明显突出的根茎痕，有紫色或黄绿色的茎及叶鞘的残基；主根（归身）表面凹凸不平；支根（归尾）上粗下细，多扭曲，有少数须根痕。质柔韧，断面黄白色或淡棕黄色，皮部厚，有裂隙及多数棕色点状分泌腔，木部色较淡，形成层环黄棕色。有浓郁的香气，味甘、辛、微苦。